易侵犯上部的邪气是
A. 湿
B. 寒
C. 暑
D. 风
E. 燥

正确答案：D。风

解析：风邪的性质是风性轻扬开泄，易袭阳位；风邪具有轻扬，升发，向上，向外的特性，常伤及头面，咽喉，皮肤，腰背（D对）。湿（A错）性趋下，易袭阴位；湿性重着，容易伤及下部。寒（B错）为阴邪，易伤阳气；寒性凝滞；寒性收引，无定向的部位。暑（C错）为阳邪，其性炙热；暑性升散，易扰心神；暑多夹湿，具有一定的季节性。燥（E错）性干燥，易伤津液；燥易伤肺。